妊娠期瘀阻胎元，使用活血化瘀药的原则是
A. 治病与安胎并举
B. 衰其大半而止
C. 禁止使用
D. 病去即止
E. 慎用

正确答案：B。衰其大半而止

解析：妊娠病的治疗原则：胎元正常者，治病与安胎并举（A错）。妊娠期有瘀阻胎元时，须在补肾安胎的基础上适当选配活血化瘀药，使瘀去胎安。所谓“有故无损，亦无损也”。但是严格掌握剂量和用药时间，原则以“衰其大半而止”，以免动胎伤胎（B对）。妊娠期用药原则：凡峻下、滑利、祛瘀、破气、耗气、散气以及一切有毒药品，都应慎用或禁用（CE错）。病去即止为崩漏等病症的治疗原则（D错）。